儿童化脓性骨髓炎的脓肿不易进入关节腔的原因是
A. 关节囊对关节腔具有保护作用
B. 儿童关节对细菌的抵抗力强
C. 骺板起屏障作用
D. 脓液容易局限和吸收
E. 脓肿容易经由软组织溃破

正确答案：C。骺板起屏障作用

解析：儿童化脓性骨髓炎好发于长骨干骺端，因为干骺端的营养动脉血流缓慢，细菌易在此处停滞。细菌首先在干骺端的骨松质内繁殖，引起局部急性炎症反应，而后白细胞坏死形成脓肿，脓肿可向骨干髓腔蔓延，由于小儿骨骺板抵抗感染力较强，不易通过，所以脓液多流入骨髓腔，而使骨髓腔受累。故儿童化脓性骨髓炎的脓肿不易进入关节腔的原因是骺板起屏障作用（C对）。关节囊对关节腔具有保护作用（A错）、儿童关节对细菌的抵抗力强（B错）、脓液容易局限和吸收（D错）及脓肿容易经由软组织溃破（E错）均与脓液不易进入关节腔原因无关。